关于脊柱的发育，不正确的是
A. 生理弯曲的形成与直立姿势有关
B. 3个月左右出现颈椎前凸
C. 6个月能坐时出现胸椎后凸
D. 1岁左右开始行走时出现腰椎前凸
E. 出生时即有颈椎前凸

正确答案：E。出生时即有颈椎前凸

解析：脊柱发育出生后的第一年脊柱增长比下肢快，以后则落后于下肢。出生时脊柱无弯曲，仅轻微后凸。3个月小儿抬头时出现颈椎前凸（第一个生理弯曲），6个月小儿能坐时出现胸椎后凸（第二个生理弯曲），1岁小儿站立行走时出现腰椎前凸（第三个生理弯曲）。至6～7岁时这3个脊柱自然弯曲才随韧带的发育而固定。故此题选择E项。掌握“骨骼发育”知识点。